李医生在为一胃癌病人手术时，发现腹腔内已有转移，肿瘤与周围组织粘连很严重，切除肿瘤已无意义，便关腹结束手术。事后发现，一把止血钳落在病人腹中。此行为被认定为三级医疗责任事故。李医生可能承担的法律责任是
A. 罚款
B. 责令暂停执业6个月
C. 注销注册
D. 赔偿患者损失
E. 追究刑事责任

正确答案：B。责令暂停执业6个月

解析：本题考查发生医疗事故医疗机构及医务人员的法律责任。李医生在为一胃癌病人手术时，发现腹腔内已有转移，肿瘤与周围组织粘连很严重，切除肿瘤已无意义，便关腹结束手术。事后发现，一把止血钳落在病人腹中。此行为被认定为三级医疗责任事故。李医生可能承担的法律责任是责令暂停执业6个月（B对）。对发生医疗事故的有关医务人员，除依照上述规定处罚外，卫生行政部门并可以责令暂停6个月以上1年以下执业活动；情节严重的，吊销其执业许可证。